99mTc核素扫描对以下哪种肿瘤有特殊的诊断意义
A. 多形性腺瘤
B. 腺淋巴瘤
C. 腺样囊性癌
D. 腺泡细胞癌
E. 黏液表皮样癌

正确答案：B。腺淋巴瘤

解析：本题考查口腔颌面部肿瘤的概念、临床表现、诊断。放射性核素检查：由于肿瘤细胞与正常细胞在代谢上有区别，核素的分布就不同。给患者服用或注射放射性核素后，可应用扫描或计数以测定放射性物质的分布情况来进行诊断和鉴别诊断。腺淋巴瘤（B对）进行99mTc核素显像呈“热”结节，具有特征性。